我国规定哪种食品中不得检出AFB₁
A. 玉米
B. 大米
C. 花生
D. 婴儿代乳食品
E. 植物油

正确答案：D。婴儿代乳食品